渗透泵型控释剂常用的半透明膜材料是
A. 醋酸纤维素
B. 乙醇
C. 聚氧化乙烯（PEO）
D. 氯化钠
E. 1.5%CMC-Na溶液

正确答案：A。醋酸纤维素

解析：本题考查渗透泵型控释剂。醋酸纤维素（A对）为渗透泵控释剂常用的纤维素类半透明膜材料；乙醇（B错）俗称酒精，易燃，可作溶剂；聚氧化乙烯（C错）为水溶性和热塑性的非离子型线性高分子聚合物，具有絮凝、增稠、缓释、润滑、分散、助留、保水等性能；氯化钠（D错）为渗透泵型控释剂的渗透促进剂；1.5%CMC-Na溶液（E错）为葡萄糖聚合度为100～2000的纤维素衍生物，用途广泛。